肉芽组织机化形成瘢痕属于
A. 代偿性肥大
B. 代偿性增生
C. 内分泌性增大
D. 病理性增生
E. 内分泌性增生

正确答案：D。病理性增生

解析：组织损伤愈合时，由成纤维细胞和毛细血管内皮细胞构成的肉芽组织机化，可形成瘢痕，此为病理性增生（D对）的表现。肥大（A错）是指由于功能增加，合成代谢旺盛，使细胞、组织或器官体积增大。代偿性增生（B错）和内分泌性增生（E错）是增生的两种类型，前者指为了适应正常的生理需要或修复损伤的组织，而发生的细胞增殖现象；后者指因激素、生长因子增多或过多而发生的组织细胞增殖现象。